餐叉畸形见于
A. 尺骨上端骨折
B. 桡骨上端骨折
C. 桡骨下端骨折
D. 尺骨下端骨折
E. 肱骨髁上骨折

正确答案：C。桡骨下端骨折

解析：桡骨下端骨折是指距桡骨下端关节面3cm以内的骨折，可分为伸直型骨折（Colles骨折）、屈曲型骨折（Smith骨折）和桡骨远端关节面骨折伴腕关节脱位（Barton骨折）。其中，“餐叉”畸形（C对）可见于Colles骨折和Barton骨折。而尺骨上端骨折（A错）、桡骨上端骨折（B错）、尺骨下端骨折（D错）及肱骨髁上骨折（E错）均不会出现“餐叉”畸形等典型表现。